消化性溃疡胃络瘀阻证的治法是
A. 疏肝理气，健脾和胃
B. 温中散寒，健脾和胃
C. 健脾养阴，益胃止痛
D. 清胃泄热，疏肝理气
E. 活血化瘀，通络和胃

正确答案：E。活血化瘀，通络和胃

解析：消化性溃疡瘀血停胃证的机理气为胃络气滞、血瘀内停，不通则痛，故治当活血化瘀、理气和胃（E对），代表方为活血化瘀，通络止痛的失笑散合行气活血的丹参饮。疏肝理气，健脾和胃（A错）治疗肝胃不和证，代表方药为柴胡疏肝散加减；温中散寒，健脾和胃（B错）可用来治疗脾胃虚寒证，代表方药为小建中汤加减；健脾养阴，益胃止痛（C错）可用来治疗胃阴不足证，代表方药用益胃汤治疗；清胃泄热，疏肝理气（D错）可用来治疗肝胃郁热证，代表方药用化肝煎合左金丸加减。